提早出现P'波，P-R为0.16秒，QRS波群形态正常，应首先考虑的诊断为
A. 房性期前收缩
B. 房性期前收缩未下传
C. 交界性期前收缩
D. 交界性逸搏
E. 室性期前收缩

正确答案：A。房性期前收缩

解析：房性早搏的心电图特点是：①提前出现的房性P'波，其形态与窦性P波不同。②房性P'波后的QRS波群，形态似窦性，P'R间期≥0.12s。③代偿间歇多不完全（A对）。房性异位激动下传时，恰逢房室交界区或心室处于绝对不应期，可出现房室传导阻滞，使房性P'波后没有QRS波群，称为房性期前收缩未下传（B错）。房室交界性早搏的心电图特点是：①提前出现的QRS波群，形态基本正常。也可因伴心室内差异传导而增宽。②提早出现的QRS波群之前或之后可有逆行P'波，也可见不到逆行P'波。③常有完全性代偿间歇（C错）。交界性逸搏见于窦性停搏及三度房室传导阻滞等。其心电图特点为：长间歇后出现一个QRS 波群，QRS呈室上性，其形态与窦性QRS波群相同或略有差别。连续出现3次或3次以上的交界性逸搏称交界性逸搏心律，频率为40～60次/min，慢而规则（D错）。室性早搏的心电图特点是：①提前出现的QRS-T波群，其前无相关P波或P'波。②QRS波群宽大畸形，时间≥0.12s。③T波与QRS波群主波方向相反。④多有完全性代偿间歇（E错）。